由平卧位突然站立，静脉回心血量减少，每搏输出量减少、动脉血压降低，是由于下列哪项引起
A. 等长调节
B. 异长调节
C. 心室后负荷增大
D. 心交感神经兴奋
E. 心迷走神经兴奋

正确答案：B。异长调节